经首次电除颤未消除心室颤动的最佳处理是
A. 连续以更高级别的能量进行电除颤3次
B. 连续以更高级别的能量进行电除颤2次
C. 连续以同样级别的能量进行电除颤2次
D. 连续以同样级别的能量进行电除颤3次
E. 进行2分钟心肺复苏后再次电除颤

正确答案：E。进行2分钟心肺复苏后再次电除颤

解析：根据2010年AHA复苏指南，不推荐连续除颤（ABCD错）。首次除颤失败后，不应该立刻进行下次除颤，而是进行5个循环的心肺复苏，即进行2分钟心肺复苏后再除颤（E对）。